下述哪项不是HEV的特点
A. HEV是 RNA 病毒
B. HEV只有3个基因型
C. HEV核昔酸序列变异不大
D. 患者潜伏期末的粪便中可检出HEV
E. 患者发病后在粪便中排出HEV数量减少

正确答案：B。HEV只有3个基因型

解析：本题考查戊肝的特点。HEV是RNA病毒（A对）；HEV有4个基因型（B错，为本题正确答案）和二十余种亚型；HEV核苷酸序列变异不大（C对）；患者潜伏期末的粪便中可检出HEV（D对）；患者发病后在粪便中排出HEV数量减少（E对）。